子宫内膜癌已累及宫颈间质，其分期应为
A. ⅠB期
B. Ⅲ期
C. ⅠA期
D. Ⅱ期
E. Ⅳ期

正确答案：D。Ⅱ期

解析：子宫内膜癌已累及宫颈间质，其分期应为Ⅱ期（D对）。现行（FIGO，2009）的子宫内膜癌手术分期标准，①Ⅰ期（A错） 肿瘤局限于子宫体；ⅠA（C错） 肿瘤浸润深度＜1/2肌层；ⅠB 肿瘤浸润深度≥1/2肌层。②Ⅱ期（D对） 肿瘤侵犯宫颈间质，但无宫体外蔓延。③Ⅲ期（B错） 肿瘤局部和（或）区域扩散；ⅢA 肿瘤累及浆膜层和（或）附件；ⅢB 阴道和（或）宫旁受累；ⅢC 盆腔淋巴结和（或）腹主动脉旁淋巴结转移，ⅢC1 盆腔淋巴结阳性，ⅢC2 腹主动脉旁淋巴结阳性伴（或不伴）盆腔淋巴结阳性。④Ⅳ期（E错） 肿瘤侵及膀胱和（或）直肠粘膜和（或）远处转移；ⅣA 肿瘤侵及膀胱和（或）直肠粘膜；ⅣB 远处转移，包括腹腔内和（或）腹股沟淋巴结转移。